卡托普利常见的不良反应是
A. 直立性低血压
B. 刺激性干咳
C. 多毛
D. 阳痿
E. 反射性心率加快

正确答案：B。刺激性干咳